关于包合物的错误表述是
A. 包合物是由主分子和客分子加合而成的分子囊
B. 包合过程是物理过程而不是化学过程
C. 药物被包合后，可提高稳定性
D. 包合物具有靶向作用
E. 包合物可提高药物的生物利用度

正确答案：D。包合物具有靶向作用

解析：本题考查包合物。关于包合物的错误表述是包合物具有靶向作用（D错，为本题正确答案）。靶向制剂包括脂质体、微囊、微球、纳米囊、纳米球等，而包合物并无靶向作用。包合技术系指一种分子被包藏于另一种分子的空穴结构内形成包合物的技术，包合物由主分子和客分子两种组分组成（A对）。包合过程是物理过程而不是化学过程（B对）。对易受热、湿、光照等影响的药物，包合后可提高稳定性（C对）。包合物可使液态药物粉末化，提高药物的生物利用度（E对）。